经过饮水、食物等从消化道传播的疾病是
A. 流行性感冒
B. 霍乱
C. 炭疽
D. 流行性乙型脑炎
E. 乙肝

正确答案：B。霍乱

解析：本题考查传染病总论。霍乱（B对）、细菌性痢疾等疾病是经过饮水、食物等从消化道进行传播的。